酪氨酸激酶抑制剂吉非替尼的特征性不良反应是
A. 痤疮样皮疹
B. 血压升高
C. 骨髓抑制
D. 心肌损伤
E. 麻痹性肠梗阻

正确答案：A。痤疮样皮疹

解析：本题考查吉非替尼的特征不良反应。痤疮样皮疹（A对）为酪氨酸激酶抑制剂吉非替尼的特征性不良反应。多柔比星的不良反应为骨髓抑制（C错）和心脏毒性（D错）。阿片类镇痛药与抗胆碱药合用有麻痹性肠梗阻（E错）危险。